共同参与型的医患关系模式最适合于
A. 急性病人
B. 绝症病人
C. 慢性病人
D. 重症病人
E. 精神病人

正确答案：C。慢性病人

解析：共同参与性医患关系模式是一种双向性的，以生物心理社会医学模式为指导思想的医患关系。特征是“医生帮助患者自我恢复”，主要适用于慢性疾病的治疗。掌握“医患沟通的理论、技术与其应用以及医患关系模式”知识点。